接受旋转变速运动刺激的是
A. 螺旋器
B. 壶腹嵴
C. 球囊斑
D. 骨螺旋板
E. 展神经

正确答案：B。壶腹嵴

解析：椭圆囊斑和球囊斑（C错）均属位觉感受器，感受头部静止的位置及直线变速运动引起的刺激。壶腹峭（B对）是位觉感受器，能感受头部旋转变速运动的刺激。在螺旋膜上有螺旋器（A错）, 又称Corti 器，是听觉感受器。